男孩，3岁。眼睑及面部水肿2周。查体：全身高度水肿，凹陷性。实验室检查：血白蛋白25g/L，总胆固醇6.2mmol/L，尿常规蛋白（++++）WBC1～2HP。为有利于该疾病的临床分型，首选的检查是
A. 血沉
B. 补体C₃
C. ASO
D. 血电解质
E. 免疫球蛋白

正确答案：B。补体C₃

解析：患儿全身凹陷性水肿，大量蛋白尿，血白蛋白25g/L（正常值＞35g/L），总胆固醇6.2mmol/L（正常值为3～5.2mmol/L），尿常规蛋白（++++）（提示患儿大量蛋白尿），根据患者症状、体征、实验室检查，考虑诊断为肾病综合征。微小病变型肾病综合征或单纯性肾病综合征患儿血清补体水平正常，肾炎型肾病综合征补体水平可下降（B对）。ASO（C错）即抗链球菌溶血素“O”，少数肾病综合征患者可有ASO升高，但并不能鉴别临床分型。血电解质（D错）各类型的肾病综合征均可发生电解质紊乱，并无特异性。查血沉（A错）、免疫球蛋白（E错）对各类肾病综合征并无特异性。